制备溶液片应选用的润滑剂为
A. 硬脂酸
B. 滑石粉
C. 硬脂酸镁
D. 微粉硅胶
E. 聚乙二醇4000

正确答案：E。聚乙二醇4000

解析：本题考查片剂辅料的润滑剂。制备溶液片应选用的润滑剂为聚乙二醇4000（E对）。片剂润滑剂：（1）聚乙二醇（PEG）常用PEG4000或PEG6000，为水溶性润滑剂，适用于可溶片或泡腾片，用量为1%～4%。（2）硬脂酸镁（C错）为白色细腻粉末。润滑性强，附着性好，但助流性差；具疏水性，用量大会影响片剂崩解，或产生裂片。硬脂酸镁呈弱碱性，某些维生素及有机碱盐等遇碱不稳定的药物不宜使用。此外，硬脂酸（A错）、硬脂酸锌和硬脂酸钙也可用作润滑剂，其中硬脂酸锌多用于粉末直接压片。（3）滑石粉（B错）为白色结晶性粉末，其成分为含水硅酸镁。不溶于水，但具亲水性；助流性、抗黏着性良好，但附着性较差。多与硬脂酸镁等联合应用，以改善后者的疏水性，用量一般为2%～3%。由于颗粒细而比重大，附着力较差，在压片中可因振动易与颗粒分离并沉在颗粒底部，造成黏冲、片面色泽不均等问题，使用时应予以注意。（4）微粉硅胶（D错）为轻质白色无定形粉末，不溶于水，但亲水性强；比表面积大（达100～350m²/g），有良好的流动性、可压性和附着性。为粉末直接压片优良的助流剂、润滑剂、抗黏附剂、吸收剂。用量为0.15%～0.3%。